小儿头围，正确的是
A. 出生时平均34cm
B. 3个月时平均42cm
C. 6个月时平均46cm
D. 1岁时平均48cm
E. 2岁时平均50cm

正确答案：A。出生时平均34cm

解析：正常新生儿初生时头围约34cm，在生后的前3个月和后9个月头围都增长约6cm，故1岁时达46cm，2岁时48cm，5岁时约50cm，15岁时接近成人头围，约54～58cm。头围的测量在2岁内小儿最有临床意义。故此题选择A项。掌握“体格生长常用指标”知识点。